蜘蛛痣罕见于下列哪种部位
A. 面颊部
B. 手背
C. 前胸
D. 上臂
E. 下肢

正确答案：E。下肢

解析：蜘蛛痣是皮肤小动脉末端分支性扩张所形成的血管痣，因形似蜘蛛而得名。蜘蛛痣出现部位多在上腔静脉分布区，如面颊部（A对）、手背（B对）、前胸（C对）、上臂（D对）等处。下肢不属于上腔静脉分布区，故蜘蛛痣罕见于下肢（E错，为本题正确答案）。